患者8岁，左右上1嵌入性脱位，正确的处理是
A. 复位固定2周后作根管治疗
B. 复位固定2天后作根管治疗
C. 观察，待其自然萌出（半年内）一定期复查牙髓活力（1年）
D. 根管治疗一观察待其自然萌出
E. 以上都不对

正确答案：C。观察，待其自然萌出（半年内）一定期复查牙髓活力（1年）

解析：本题考查嵌入性脱位的处理。年轻恒牙发生嵌入性脱位，由于其根端开扩，血管神经愈合能力较强，为了避免对牙周膜和根尖-牙髓血管的在此损伤，不宜将牙拉出复位，应观察牙齿自行再萌出。一般为半年内萌出，并在复查中应密切观察牙髓状态的转归（C对），若牙髓坏死应及时摘除牙髓，进行根尖诱导形成术诱导牙根继续发育。复位固定2周后作根管治疗（A错），复位固定2天后作根管治疗（B错）均会导致根部活髓受损，影响牙根继续发育，不利于根尖孔愈合。根管治疗后活髓破坏年轻恒牙不会自然萌出（D错）。